当白细胞和血小板下降到什么状态时，应考虑停用化疗药
A. 白细胞4.0×10⁹/L，血小板10×10⁹/L
B. 白细胞3.0×10⁹/L，血小板10×10⁹/L
C. 白细胞4.0×10⁹/L，血小板80×10⁹/L
D. 白细胞3.0×10⁹/L，血小板80×10⁹/L
E. 白细胞3.0×10⁹/L，血小板60×10⁹/L

正确答案：D。白细胞3.0×10⁹/L，血小板80×10⁹/L

解析：化疗药物的不良反应是骨髓抑制。对造血系统有抑制作用的药物多为细胞毒类。当白细胞数降到3×10⁹/L，血小板计数降到80×10⁹/L时，应予停药并应用升白药物。白细胞严重减少时，应给以抗生素或丙种球蛋白以预防感染。掌握“口腔颌面部肿瘤的治疗原则及预防”知识点。